所含蛋白质最多的是
A. 胚
B. 胚乳
C. 谷皮
D. 全谷粒
E. 糊粉层

正确答案：B。胚乳